下列各项除哪项外，均是消渴发病的主要病机
A. 燥热
B. 气虚
C. 阴虚
D. 血瘀
E. 水停

正确答案：E。水停

解析：消渴的病机主要在于阴津亏损，燥热偏盛，而以阴虚为本，燥热为标（A对）。消渴日久，阴伤及气，可出现消渴气阴两虚证（B对）。消渴以阴虚为本，燥热为标（C对）。消渴阴虚内热，损津耗液，血脉为之虚涩而成血瘀证。气阴两虚或阴阳两虚，使血液生化乏源、运行无力而致血瘀证。血瘀又可使脏腑失养（D对）。消渴阴虚为本，燥热为标，津液损伤，极少出现水停之证，若为水停证，当在消渴病后期并发症（E错，为本题正确答案）。